关于塑制法制备大蜜丸的叙述，正确的是
A. 塑制法制备大蜜丸的工艺流程为：物料准备-制丸块-分粒-干燥-整丸
B. 用蜜量是影响丸块质量的唯一重要因素
C. 含有较多胶类、粘液质等较强粘性药料时，应以热蜜和药
D. 含胶类、糖类较多的药粉用蜜量宜少
E. 以嫩蜜、中蜜、老蜜制成的蜜丸，一般均须于60℃～80℃干燥

正确答案：D。含胶类、糖类较多的药粉用蜜量宜少